伸膝并屈髋关节的肌
A. 臀大肌
B. 髂腰肌
C. 臀中肌
D. 股直肌
E. 股二头肌

正确答案：D。股直肌

解析：臀大肌（A错）使髋关节伸和旋外。髂腰肌（B错）使髋关节前屈和旋外。臀中肌（C错）使髋关节外展、旋内（前部肌束）和旋外（后部肌束）。股直肌（D对）属于股四头肌，屈髋关节和伸膝关节。股二头肌（E错）屈膝、伸髋，使已屈的膝关节旋外。